能扩张肾血管增加尿量及升高血压的药物是
A. 肾上腺素
B. 阿托品
C. 异丙肾上腺素
D. 多巴胺
E. 去甲肾上腺素

正确答案：D。多巴胺

解析：多巴胺（D对）在高浓度的时候，可以激动血管的α受体，导致血管收缩，引起外周阻力增加，使血压升高。对肾脏的作用具有双重性的特点，小剂量时作用于肾血管D₁受体，使血管舒张，肾血流量增加，肾小球滤过率增加，尿量增加；大剂量则兴奋α₁受体，引起肾血管收缩，肾血流量减少，肾小球滤过率降低，尿量减少。肾上腺素（A错）的作用效果与靶器官中肾上腺素受体亚型的分布有关，肾血管的平滑肌α受体在数量上占优势，故肾上腺素与α受体结合，可使肾血管收缩，尿量减少。阿托品（B错）在治疗剂量单独使用时，对血管与血压无明显影响。异丙肾上腺素（C错）为β肾上腺素受体激动药，对肾血管的舒张效果较弱。去甲肾上腺素（E错）为α肾上腺素受体激动剂，激动肾脏血管的α₁受体，引起肾血管收缩，肾血流量减少，肾小球滤过率降低，尿量减少。